小柴胡颗粒既能疏肝和胃，又能
A. 透解郁热
B. 散结解郁
C. 解表散热
D. 消胀止痛
E. 健脾消食

正确答案：C。解表散热

解析：本题考查的是小柴胡颗粒的功能。小柴胡颗粒既能疏肝和胃，又能解表散热（C对）。小柴胡颗粒：【功能】解表散热，疏肝和胃。四逆散：【功能】透解郁热（A错），疏肝理脾。散结解郁（B错）为理气药的功效。凡以疏畅气机为主要功效的药物，称为理气药。本类药味多辛苦，气多芳香，性多偏温，主归脾、胃、肝、肺经，善于行散或泄降，主能理气调中、疏肝解郁、理气宽胸、行气止痛、破气散结，兼能消积、燥湿。柴胡舒肝丸：【功能】疏肝理气，消胀止痛（D错）。健脾康儿片：【功能】健脾养胃，消食（E错）止泻。